在整个病变过程中没有肺泡壁和其他结构损坏的肺炎是
A. 克雷伯杆菌肺炎
B. 金黄色葡萄球菌肺炎
C. 干酪性肺炎
D. 绿脓杆菌肺炎
E. 肺炎链球菌肺炎

正确答案：E。肺炎链球菌肺炎

解析：肺炎链球菌肺炎（E对）的X线征象呈肺叶或肺段实变，无空洞，可伴胸腔积液，且肺炎链球菌肺炎是由肺炎链球菌引起，肺炎链球菌不产生毒素，不引起组织坏死或形成空洞。金黄色葡萄球菌肺炎（B错）的X线征象呈肺叶或小叶浸润，早期空洞，脓胸，可见液气囊腔。克雷伯杆菌肺炎（A错）的X线征象呈肺叶或肺段实变，蜂窝状脓肿，叶间隙下坠。绿脓杆菌肺炎（D错）（铜绿假单胞菌肺炎）的X线征象呈弥漫性支气管炎，早期肺脓肿。干酪性肺炎（C错）（P68）的X线征象呈大叶性密度均匀磨玻璃状阴影，逐渐溶解，呈虫蚀样空洞。